某医院统计了1995～2000年住院治疗的食管癌新病例的基本情况，结果如下：1995年、1996年、1997年、1998年、1999年、2000年住院人数为45、50、65、76、82、85，占总住院病人比例分别为8％、7％、6％、5％、4.5％、4％，以下结论和理由均正确的是
A. 住院人数统计结果表明人群食管癌发病风险逐年升高
B. 根据食管癌所占病例的比例来看，人群食管癌发病风险逐年下降
C. 不能确定人群食管癌发病风险的时间趋势，因为没有进行住院比例的统计学检验
D. 不能确定人群食管癌发病风险的时间趋势，因为上述指标不能反映人群发病率
E. 不能确定人群食管癌发病风险的时间趋势，因为住院人数和比例结果相互矛盾

正确答案：D。不能确定人群食管癌发病风险的时间趋势，因为上述指标不能反映人群发病率